医学道德评价的标准是
A. 经济标准社会标准科学标准
B. 科学标准实践标准疗效标准
C. 疗效标准医学标准科学标准
D. 疗效标准行为标准科学标准
E. 疗效标准社会标准科学标准

正确答案：E。疗效标准社会标准科学标准

解析：目前，我国医德评价的客观标准主要有疗效标准、社会标准和科学标准（E对）。疗效标准即医疗行为是否有利于患者的康复或疾患的缓解和根除。这是衡量医疗行为是否符合道德的重要标准，也是医德评价标准中最基本的尺度。社会标准即医疗行为是否有利于人类生存环境的保护和改善。随着社会的进步和医学科学的发展，人们对医学的需求越来越高，这就要求医务人员的行为应着眼于社会进步和发展，有利于人类生存环境的保护和改善，既要重视疾病的治疗和预防，也要重视群众的卫生保健和人类的优生优育。科学标准即医疗行为是否有利于医学科学的发展和进步。医学是保护人的生命、增进人类健康的科学。医学的发展对人们防病治病、促进健康起着重要作用。医务人员应该刻苦钻研业务，不畏艰险，不图名利，团结协作，大胆创新，不断攻克医学中的难题，促进医学科学的不断发展。这三条标准相辅相成，是不可或缺的有机整体，其中心和实质是维护患者身心健康，在根本上是一致的。